男，52岁。公司经理，吸烟10年，每天2包。体重75kg，身高166cm。患者的BMI是
A. 21.4
B. 23.5
C. 25.8
D. 27.1
E. 29.4

正确答案：D。27.1

解析：体重指数（简称BMI），是用体重公斤数除以身高米数平方得出的数字，是目前国际上常用的衡量人体胖瘦程度以及是否健康的一个标准。在我国BMI是18.5～23.9代表正常，≥24代表超重，24～27.9代表偏胖，≥28代表肥胖。本例患者身高166cm，体重75kg，根据体重指数公式可得BMI=75/1.66²≈27.1。故患者的BMI是27.1（D对ABCE错）。